在鼓室后壁上有
A. 前庭窗
B. 面神经管凸
C. 蜗窗
D. 乳突窦开口
E. 咽鼓管的开口

正确答案：D。乳突窦开口

解析：鼓室内侧壁的岬的后上方有卵圆形小孔，称前庭窗（A错）或卵圆窗，通向前庭。前庭窗的后上方有一弓形隆起，称面神经管凸（B错），内藏面神经。鼓室内侧壁岬的后下方有一圆形小孔，称蜗窗（C错）或圆窗。后壁为乳突壁，上部有乳突窦的开口（D对）。咽鼓管骨部开口（E错）于鼓室前壁的咽鼓管鼓室口。